均数为0，标准差为1的分布是
A. 正态分布
B. 标准正态分布
C. 正偏态分布
D. 负偏态分布
E. 非正态分布

正确答案：B。标准正态分布

解析：均数（μ）和标准差（σ）为正态分布的两个参数，均数为0，标准差为1的分布是标准正态分布（B对）。任意一个服从N（μ，σ²）分布的随机变量X，经变化都可转换为μ=0和σ=1的标准正态分布。